郁金的主治病证有
A. 癥瘕痞块
B. 癫痫发狂
C. 妇女倒经
D. 胁肋胀痛
E. 湿热黄疸

正确答案：A、B、C、D、E。癥瘕痞块；癫痫发狂；妇女倒经；胁肋胀痛；湿热黄疸

解析：本题考查的是郁金的主治病证。郁金的主治病证有癥瘕痞块（A对）、癫痫发狂（B对）、妇女倒经（C对）、胁肋胀痛（D对）与湿热黄疸（E对）。郁金：【主治病证】（1）胸腹胁肋胀痛或刺痛，月经不调，痛经，癥瘕痞块。（2）热病神昏，癫痫发狂。（3）血热之吐血、衄血、尿血，妇女倒经。（4）湿热黄疸，肝胆或泌尿系结石症。